上颌左1234右123456缺失属于Kennedy分类哪一类
A. 第三类第二亚类
B. 第三类第三亚类
C. 第三类
D. 第四类第一亚类
E. 第四类

正确答案：E。第四类

解析：本题考查牙列缺损的Kennedy分类。上颌左1234右123456缺失，属于牙弓前部连续缺失并跨过中线，且在缺隙远中有天然牙存在，因此为Kennedy第四类（E对）。Kennedy第四类为单缺隙，无亚类（D错）。Kennedy第三类（C错）是指牙弓的一侧牙缺失，且缺隙两端均有天然牙存在。除主要缺隙外的缺牙间隙数目作为亚类（AB错）。